女，50岁，大便习惯改变伴体重减轻2个月，近2个月来无诱因排稀便，5～6次/日，偶伴少量脓血粘便，便前腹痛，查体：T36.5℃，P80次/分，R18次/分，BP120/80mmHg，双肺呼吸音清，未闻及干湿性啰音，心率80/分，律齐，腹软，左下腹可触及一质硬、固定、椭圆形包块，肠鸣音亢进，最可能的诊断是
A. 结肠息肉
B. 乙状结肠癌
C. 乙状结肠扭转
D. 溃疡性结肠炎
E. 肠套叠

正确答案：B。乙状结肠癌

解析：老年患者，排便习惯和粪便性状改变，腹痛，肠鸣音亢进，体重减轻，左下腹可触及一质硬、固定、椭圆形包块，最可能的诊断是乙状结肠癌（B对）。结肠息肉（A错）肿块质软可推动（P384）。乙状结肠扭转（C错）多见于乙状结肠冗长、有便秘的老年人，以往可有多次腹痛发作经排气、排便后缓解的病史。病人有腹部持续胀痛，左腹部明显膨胀，可见肠型（P364）。肠套叠（E错）多见于幼儿，三大典型症状是腹痛、血便和腹部肿块。血便为果酱样血便。腹部触诊常可扪及腊肠形、表面光滑、稍可活动、具有压痛的肿块，常位于脐右上方，而右下腹扪诊有空虚感（P364）。